患者，女，45岁。近期多次晕厥，查体发现坐体在心尖部可闻及舒张期杂音，卧位消失。此患者晕厥原因可能是
A. 二尖瓣狭窄
B. 主动脉瓣狭窄
C. 左房黏液瘤
D. 主动脉瓣下狭窄
E. 主动脉瓣半闭不全

正确答案：C。左房黏液瘤

解析：左房黏液瘤（C对）由于重力的作用，当坐位或站位是，阻塞二尖瓣口，由此产生随体位改变的舒张期杂音，左心房的血不能顺利流入左心室，导致左心室的血液减少，使脑血管供血不足而晕厥。二尖瓣狭窄（A错）表现为呼吸困难、咳嗽、咯血、血栓栓塞等症状，主动脉狭窄（B错）有15～30%的患者出现晕厥，多于劳动有关，发生在劳力当时，少数在休息是发生。但是不随体位变化而变化。主动脉瓣下狭窄（D错）通常无症状，体格检查发现收缩期杂音而就诊，杂音不伴有喀喇音。儿童一般无症状，成人可有胸闷、不适。1岁以内单纯瓣下狭窄少见，随着年龄增长，梗阻进行性加重，出现主动脉瓣关闭不全。患者耐力减退，但心绞痛和昏厥比较少见。主动脉瓣关闭不全（E错）有典型的舒张期杂音伴周围血管征。轻症者可无任何症状，重者可出现突发呼吸困难，不能平卧，全身大汗，频繁咳嗽，咳白色或粉红色泡沫痰，更重者可出现烦躁不安，神志模糊，神志昏迷。